损伤后导致眼睑下垂
A. 滑车神经
B. 展神经
C. 面神经
D. 动眼神经
E. 三叉神经

正确答案：D。动眼神经

解析：滑车神经（A错）支配上斜肌，损伤后导致外斜视。展神经（B错）损伤可引起外直肌瘫痪，产生内斜视。面神经（C错）损伤后出现损伤侧表情肌瘫痪，如口角偏向健侧、不能鼓腮。说话时唾液从口角流出。伤侧额纹消失、鼻唇沟变平坦。眼轮匝肌瘫痪使闭眼困难、角膜反射消失等症状。动眼神经（D对）支配上睑提肌，损伤后导致眼睑下垂。三叉神经（E错）损伤后表现为神经损伤侧面部皮肤以及口、鼻腔黏膜感觉障碍，角膜反射消失，咀嚼肌瘫痪。